口腔、咽及颈部严重出血时，一般压迫颈总动脉不超过
A. 1分钟
B. 2分钟
C. 3分钟
D. 4分钟
E. 5分钟

正确答案：E。5分钟

解析：口腔、咽及颈部严重出血时，可直接压迫患侧颈总动脉，用拇指在胸锁乳突肌前缘，环状软骨平面将颈总动脉压在第6颈椎横突上，持续时间一般不超过5分钟，也禁止双侧同时压迫，否则会导致脑缺血。掌握“口腔颌面部创伤急救”知识点。